患者，男，18岁，因鼻塞症状加重就诊，医生处方1%盐酸麻黄滴鼻液。下列关于该滴鼻液用药指导的说法，错误的是
A. 萎缩性鼻炎患者可增加给药次数
B. 用药前要将鼻腔分泌物清理干净
C. 滴管头不要碰到鼻部，避免污染药液
D. 滴药后，要静卧3～5分钟
E. 滴药后，要轻压双侧鼻翼3～4次

正确答案：A。萎缩性鼻炎患者可增加给药次数

解析：本题考查盐酸麻黄滴鼻液的使用。萎缩性鼻炎患者应按正常剂量使用，不可增加给药次数（A错，为本题正确答案）。麻黄素属于拟肾上腺素药，可以兴奋α肾上腺素能受体，对鼻腔黏膜血管收缩作用的特点是迅速显效、作用短暂，紧随短暂的血管收缩作用之后就是反跳效应，导致更为严重的鼻塞。且连续使用麻黄素滴鼻后，可导致药物性鼻炎。药液过浓或滴入次数过多可致反应性充血等。用滴鼻药前要将鼻涕擤干净（B对），向鼻内滴药时，滴管头不要碰到鼻部，以免污染药液（C对）。滴药后，要静卧3～5分钟（D对），并轻压双侧鼻翼3～4次（E对），让药液与鼻黏膜接触，然后坐起，使多余药液从前鼻孔流出。